男，50岁。车祸致左小腿骨折，断端外露，创口出血。查体：T36.6℃，P96次/分，BP140/80mmHg，双肺呼吸音清，未闻及湿性啰音，心率96次/分，心律齐，腹软，无压痛，现场急救人员行临时夹板固定，其最主要的目的是
A. 防止休克
B. 预防脂肪栓塞
C. 避免搬运过程中加重损伤
D. 减少出血
E. 便于手术复位

正确答案：C。避免搬运过程中加重损伤

解析：患者中老年男性，车祸致左小腿骨折，断端外露（为开放性骨折），创口出血。固定是骨折急救的重要措施。现场急救人员行临时夹板固定，其最主要的目的是避免搬运过程中加重损伤（C对），如对其周围血管、神经的二次损害。患者查体良好，无休克征象（A错）。减少出血（D错）为包扎伤口的主要目的。